可导致药源肝损害的药物有
A. 氟康唑
B. 辛伐他汀
C. 利福平
D. 对乙酰氨基酚
E. 罗红霉素

正确答案：A、B、C、D。氟康唑；辛伐他汀；利福平；对乙酰氨基酚

解析：本题考查药源性肝损害。利福平（C对）、对乙酰氨基酚（D对）、氟康唑（A对）、辛伐他汀（B对）可引起药物性肝损伤。罗红霉素（E错）可引起药源性胰腺炎。